以下不属于釉质发育不全病因的是
A. 严重营养障碍
B. 婴儿和母体的疾病
C. 局部因素
D. 重度磨耗
E. 内分泌失调

正确答案：D。重度磨耗

解析：本题考查牙釉质发育不全的病因。以下不属于釉质发育不全病因的是重度磨耗（D错，为本题的正确答案）。牙釉质发育不全的病因：1.严重营养障碍（A对）：维生素A、C、D以及钙磷的缺乏，均可影响成釉细胞分泌牙釉质基质和矿化。维生素A缺乏，对上皮组织的影响很明显，而牙釉质为上皮组织的成釉细胞所形成；维生素C缺乏时，成釉细胞不能分化成高柱状细胞而蜕变成扁平细胞，使牙釉质发育不全。维生素D严重缺乏时，钙盐在骨和牙组织中的沉积迟缓，甚至停止；一旦形成牙釉质基质，由于得不到及时的矿化，基质不能保持它的形状而塌陷，这些都是牙釉质表面上形成凹陷和矿化不良的原因。2.内分泌失调（E对）：甲状旁腺与钙磷代谢有密切关系。甲状旁腺功能降低时，血清中钙含量降低，血磷正常或偏高，其牙也可能出现发育缺陷，肉眼能见到牙面横沟或在镜下见到加重的发育间歇线。3.婴儿和母体的疾病（B对）：小儿的一些疾病，如水痘、猩红热等均可使成釉细胞发育发生障碍。严重的消化不良，也可成为牙釉质发育不全的原因。孕妇患风疹、毒血症等也可能使胎儿在此期间形成的牙釉质发育不全。发病急、病程短的疾病，仅使牙釉质形成一条窄的横沟缺陷，如果正值牙发育的间隙期，则不引起釉质发育不全。4.局部因素（C对）：常见于乳牙根尖周严重感染，导致继承恒牙牙釉质发育不全。这种情况往往见于个别牙，以前磨牙居多，又称特纳（Turner）牙。